慢性化脓性唾液腺炎挤压患侧唾液腺时在导管口流出的液体为
A. 大量而稀薄的液体
B. 少量脓液状苦味液体
C. 少量黏稠的脓性液体
D. 大量浓稠的甜味液体
E. 少量黏稠有咸味的液体

正确答案：E。少量黏稠有咸味的液体

解析：患慢性化脓性唾液腺炎时，若挤压患侧唾液腺，导管口流出少量黏稠而有咸味的液体。掌握“慢性唾液腺炎的病理变化”知识点。